能抑制甲状腺素合成，又抑制外周组织中T₄变为T₃，还抑制免疫球蛋白生成的药物是
A. 碘化物
B. 甲疏咪唑
C. 丙基硫氧嘧啶
D. 卡比马唑（甲亢平）
E. 普萘洛尔

正确答案：C。丙基硫氧嘧啶